牙釉质晶体形成时，最初形成的矿化物是
A. 氯化铅
B. 碳酸盐
C. 碳酸钠
D. 氯化铁
E. 碳磷灰石

正确答案：E。碳磷灰石

解析：在牙釉质晶体形成时，最初形成的矿化物是碳磷灰石。掌握“牙釉质”知识点。